低钾血症时出现
A. 酸中毒时酸性尿
B. 反常性碱性尿
C. 碱中毒时碱性尿
D. 反常性酸性尿
E. 酸碱平衡时酸性尿

正确答案：D。反常性酸性尿

解析：发生低钾血症时由于肾小管上皮细胞内缺钾，K+ -Na+交换减少，代之H+-Na+ 交换增多，H+排出增多，尿液尿液H+升高，出现反常性酸性尿（D对）。